主要来自于建筑材料的室内污染物是
A. SO₂
B. NOₓ
C. CO
D. 氡及其子体
E. 微生物

正确答案：D。氡及其子体

解析：本题考查主要来自于建筑材料的室内污染物。室内空气污染物的种类很多，包括化学性、物理性、生物性和放射性四大类。建筑材料的室内污染物主要包括各种有毒物质，其中氡及其子体（D对ABCE错）是最主要的污染物之一。氡是一种致癌的放射性物质，它具有较高的游离度，可以在大气中迁移，并有可能进入室内环境。